患者外伤，血压90/50mmHg，全腹压痛反跳痛，肌紧张，移动性浊音阳性，首选治疗是
A. 抗休克治疗，急症准备手术
B. 输血抗休克
C. 静脉注射糖皮质激素
D. 平卧休息
E. 观察

正确答案：A。抗休克治疗，急症准备手术

解析：患者外伤，血压90/50mmHg，全腹压痛反跳痛，肌紧张，移动性浊音阳性，结合患者的表现，考虑为腹内脏器损伤，首选抗休克治疗，急症准备手术治疗（A对）。